上皮有过度角化，粒层明显，角化层剥脱，可见角质栓塞，棘层变薄，基底细胞液化变性，基底膜不清晰，是以上哪种疾病的病理表现
A. 慢性盘状红斑狼疮
B. 良性黏膜类天疱疮
C. 扁平苔藓
D. 白斑
E. 红斑

正确答案：A。慢性盘状红斑狼疮

解析：慢性盘状红斑狼疮上皮表面有过度角化或不全角化，粒层明显，角化层可有剥脱，有时可见角质栓塞；上皮变薄，可见上皮钉突增生、伸长；基底细胞发生液化、变性，基底膜不清晰。掌握“口腔扁平苔藓与慢性盘状红斑狼疮”知识点。